预防百日咳白喉破伤风疫苗初种年龄
A. 生后2～3天到2个月之内
B. 2个月以上
C. 9个月以上易感儿
D. 3个月以上小儿
E. 1岁以上

正确答案：D。3个月以上小儿

解析：本题考查预防百日咳白喉破伤风疫苗的初种年龄。新生儿从母体获得百日咳被动免疫抗体的量极微，婴儿早期容易发病，而且威胁较大。我国规定分别于生后3月龄（D对ABCE错）开始接种脊髓灰质炎疫苗。